免疫球蛋白的功能区Fc段相当于IgG的
A. CH1和CH2结构域
B. CH2和CH3结构域
C. CH1和CH3结构域
D. CH2和CH4结构域
E. CH3和CH4结构域

正确答案：B。CH2和CH3结构域

解析：Fc受体结合Ig的Fc段。Fc段相当于IgG的CH2和CH3结构域。掌握“免疫球蛋白基本概念及结构”知识点。